关于垃圾焚烧不正确的是
A. 焚烧炉应当设在当地主导风向的下风向侧，距居民区500m以上
B. 烟囱高度至少30m，以利烟气扩散
C. 垃圾的水分和灰分分别不应超过50%和45%
D. 垃圾应在焚烧炉内充分燃烧，烟气在后燃室应在不低于850℃的条件下停留不少于2秒
E. 垃圾应在焚烧炉内充分燃烧，烟气在后燃室应在不低于700℃的条件下停留不少于2秒

正确答案：E。垃圾应在焚烧炉内充分燃烧，烟气在后燃室应在不低于700℃的条件下停留不少于2秒

解析：本题考查垃圾焚烧。在进行垃圾焚烧时，焚烧炉应当设在当地主导风向的下风向侧，距居民区500m以上（A对）；烟囱高度至少30m，以利烟气扩散（B对）；垃圾的水分和灰分分别不应超过50%和45%（C对）；垃圾应在焚烧炉内充分燃烧，烟气在后燃室应在不低于850℃（D对）的条件下停留不少于2秒（E错，为本题正确答案）。